哪种情况下舌杆需离开黏膜0.3～0.4mm
A. 下颌舌侧牙槽骨形态为垂直型，非游离缺失
B. 下颌舌侧牙槽骨形态为垂直型，游离缺失
C. 下颌舌侧牙槽骨形态为斜坡型，非游离缺失
D. 下颌舌侧牙槽骨形态为斜坡型，游离缺失
E. 下颌舌侧牙槽骨形态为倒凹型

正确答案：D。下颌舌侧牙槽骨形态为斜坡型，游离缺失

解析：本题考查舌杆与黏膜的关系。为防止义齿受力下沉后舌杆压迫软组织，舌杆与黏膜间应预留适当的缓冲间隙。缓冲量根据下颌舌侧牙槽骨的三种形态有所不同。斜坡型者舌杆与黏膜稍分离，缓冲量一般为0.3～0.5mm；如果两侧是单个后牙非游离缺失或间隔缺失，可用缺隙两侧邻牙做基牙，制作活动桥，则不需要使用舌杆。所以下颌舌侧牙槽骨形态为斜坡型，游离缺失（D对C错）舌杆需离开黏膜0.3～0.4mm。垂直型者（AB错）无论是否是游离缺失，舌杆都应与黏膜平行接触，缓冲量最小。对于倒凹形者（E错）舌杆应该在倒凹之上或在倒凹区留出空隙并在骨突区充分缓冲。